治疗类风湿关节炎时，必须提醒患者每周用药一次，避免用药过量造成再生障碍性贫血等药源性疾病的药物是
A. 来氟米特
B. 泼尼松
C. 雷公藤多苷
D. 白芍总苷
E. 甲氨蝶呤

正确答案：E。甲氨蝶呤

解析：本题考查药物不良反应。治疗类风湿关节炎时，必须提醒患者每周用药一次，避免用药过量造成再生障碍性贫血等药源性疾病的药物是甲氨蝶呤（E对）。常见不良反应有恶心、口炎、腹泻、脱发、皮疹，少数出现骨髓抑制、听力损害、肺间质病变，也可引起流产、畸胎和影响生育能力。来氟米特（A错）不良反应主要有腹泻、瘙痒、高血压、肝酶升高、皮疹、脱发以及一过性白细胞下降等。泼尼松（B错）属于糖皮质激素类药物，长期大量应用可引起医源性肾上腺皮质功能亢进综合征、消化道溃疡、骨质疏松、停药反应等。雷公藤多苷（C错）主要不良反应是性腺抑制，导致男性不育和女性闭经。雷公藤还可以引起纳差、恶心、呕吐、腹痛、腹泻等，可有骨髓抑制作用，并导致可逆性肝酶升高和血肌酐清除率下降。白芍总苷（D错）毒副作用小，不良反应有便次增多、轻度腹痛、纳差。